天仙子含有的主要生物碱是
A. 东莨菪碱
B. 汉防己碱
C. 乌头碱
D. 巴马汀
E. 药根碱

正确答案：A。东莨菪碱

解析：本题考查的是了天仙子的主要生物碱。天仙子含有的主要生物碱是东莨菪碱（A对）。天仙子主要的生物碱有莨菪碱和东莨菪碱等。《中国药典》以东莨菪碱和莨菪碱为指标成分进行含量测定，要求两者总量不得少于0.080%。汉防己碱（B错）是防己中的主要生物碱。防己的有效成分为生物碱，总生物碱含量可达2.3%～5%，其中汉防己甲素（粉防己碱），约为1%，汉防己乙素（防己诺林碱）约为0.5%。《中国药典》以粉防己碱和防己诺林碱为指标成分进行含量测定，对药材要求两者总量不得少于1.6%；对饮片要求两者总量不得少于1.4%。乌头碱（C错）是川乌中的主要生物碱。川乌中主要毒性生物碱及其化学结构：乌头和附子主要含二萜类生物碱，属于四环或五环二萜类衍生物。乌头生物碱的结构复杂、结构类型多。其重要和含量较高的有乌头碱、次乌头碱和新乌头碱，《中国药典》以三者为指标成分进行含量测定，要求三者总量应为0.050～0.17%。巴马汀（D错）和药根碱（E错）是黄连中的主要生物碱。黄连的有效成分主要是生物碱，已经分离出来的生物碱有小檗碱（含量最高）、巴马汀、黄连碱、甲基黄连碱、药根碱和木兰碱（属于阿朴菲型）等；大多属苄基异喹啉类衍生物，季铵型生物碱。《中国药典》以小檗碱为指标成分进行含量测定。以盐酸小檗碱计，要求味连含小檗碱不得少于5.5%，表小檗碱不得少于0.80%，黄连碱不得少于1.6%，巴马汀不得少于1.5%；要求雅连含小檗碱不得少于4.5%；要求云连含小檗碱不得少于7.0%。